研究报道表明每天使用2次酚类化合物含漱，可平均减少菌斑量及降低龈炎指数为
A. 0.25
B. 0.35
C. 0.45
D. 0.55
E. 0.65

正确答案：B。0.35

解析：酚类化合物又称香精油主要为麝香草酚、薄荷醇和甲基水杨酸盐混合而成的抗菌斑制剂，主要用作漱口剂，每天2次，短期研究效果可减少菌斑量及降低龈炎指数平均35%。掌握“菌斑控制及提高宿主抵抗力”知识点。